以下药物中，在临床上需要检测血药浓度的是
A. 阿司匹林
B. 对乙酰氨基酚
C. 维生素C
D. 葡萄糖
E. 地高辛

正确答案：E。地高辛

解析：本题考查在临床上需要检测血药浓度的药物。在临床上需要检测血药浓度的是地高辛（E对）。肾功能减退时，地高辛的代谢减慢，消除半衰期延长，血药浓度升高，可能引起毒性，故需要监测血药浓度。